男，45岁。发热、咳脓痰1周。胸部X线片示右下叶背段浸润阴影。用头孢呋辛治疗体温稍下降，但痰量增多，为脓血痰，有臭味。1周后复查胸部X线片示大片浸润阴影中出现空洞。治疗中需加用的药物是
A. 阿米卡星
B. 左氧氟沙星
C. 甲硝唑
D. 红霉素
E. 万古霉素

正确答案：C。甲硝唑

解析：患者为中年男性，发热、咳脓臭痰（为肺脓肿的典型临床表现），胸部X线片示右下叶背段浸润阴影，且出现空洞，根据其临床表现和辅助检查，可初步诊断为肺脓肿。该患者用头孢呋辛（为二代头孢类抗生素，对革兰阳性菌和革兰阴性杆菌有效，对厌氧菌无效）治疗体温稍下降，但痰量增多，为脓血痰，有臭味，说明肺脓肿合并厌氧菌的感染。厌氧菌一般均对青霉素敏感，仅脆弱拟杆菌对青霉素不敏感，但对林可霉素、克林霉素和甲硝唑（C对）敏感，故治疗中需要加用甲硝唑。阿米卡星（A错）是一种氨基糖苷类抗生素，厌氧菌常对氨基糖苷类抗生素有耐药性。左氧氟沙星（B错）属于喹诺酮类药物，对革兰阴性杆菌有较强的杀菌作用。红霉素（D错）为大环内酯类抗生素，为支原体、衣原体、军团菌感染首选。万古霉素（E错）用于治疗耐甲氧西林金黄色葡萄球菌的感染。